属于表里双解的方剂有
A. 半夏泻心汤
B. 痛泻要方
C. 逍遥散
D. 四逆散
E. 葛根黄芩黄连汤

正确答案：E。葛根黄芩黄连汤

解析：表里双解剂，以表里同治、内外分解等作用为主，用于治疗表里同病的方剂。适用于表证未解，又见里证，或原有宿疾，复感表邪，出现表证与里证同时并见的证候。葛根芩连汤主治表证未解，邪热入里证（E对）。半夏泻心汤主治寒热互结之痞证。痛泻药方主治脾虚肝郁之痛泻。逍遥散主治肝郁血虚脾弱证。四逆散主治阳郁厥逆证；肝脾不和证。故半夏泻心汤、痛泻药方、逍遥散、四逆散均属于和解剂（ABCD错）。